桑白皮与葶苈子均能
A. 燥湿化痰
B. 敛肺平喘
C. 润肠通便
D. 泻肺平喘
E. 温肺祛痰

正确答案：D。泻肺平喘

解析：本题考查的是桑白皮与葶苈子的功效。桑白皮与葶苈子均能泻肺平喘（D对）。桑白皮：【功效】泻肺平喘，利水消肿。葶苈子：【功效】泻肺平喘，利水消肿。白附子：【功效】燥湿化痰（A错），祛风止痉，解毒散结。白果：【功效】敛肺平喘（B错），止带缩尿。苦杏仁：【功效】降气止咳平喘，润肠通便（C错）。芥子：【功效】温肺祛痰（E错），利气散结，通络止痛。